脑桥内与小脑相关联的核团是
A. 三叉神经脑桥核
B. 上橄榄核
C. 脑桥核
D. 上泌涎核
E. 无

正确答案：C。脑桥核

解析：三叉神经脑桥核（A错）是三叉神经感觉核的膨大部，下接三叉神经脊束核；脑桥核（C对）是传递大脑皮质信息至小脑的重要中继站；上橄榄核（B错）位于脑桥中下部的被盖腹侧部，内侧丘系的背外侧，脊髓丘脑束的背侧；上泌涎核（D错）位于脑桥的最下端，该核的神经元散在于面神经核尾侧部周围的网状结构内，故核团轮廓不清。